某医师治高热惊厥、烦躁不安、神昏谵语，常用局方至宝散。此因该中成药除能清热解毒外，又能
A. 止痉安神
B. 祛痰开窍
C. 镇静安神
D. 平肝镇惊
E. 开窍镇惊

正确答案：E。开窍镇惊

解析：本题考查局方至宝丸的功能。此因该中成药除能清热解毒外，又能开窍镇惊（E对）。局方至宝丸【功能】清热解毒，开窍镇惊。紫雪散【功能】清热开窍，止痉安神（A错）。牛黄【功效】清热解毒，息风止痉，化痰开窍（B错）。琥珀抱龙丸【功能】清热化痰，镇静安神（C错）。礞石【功效】消痰下气，平肝镇惊（D错）。